男，55岁。腹胀、少尿1年。曾诊断为“乙肝肝硬化”，未系统治疗。近1天呕血2次，量约500ml，排黑便1次，约100g，感头晕、心悸，于县医院急症就诊。既往有冠心病病史2年，间断口服药物治疗。查体：血压80/50mmHg，神志清，贫血貌，巩膜轻度黄染。心率108次/min，律齐。全腹无压痛及反跳痛，肝肋下未触及，脾肋下2cm，腹水征（+），肠鸣音活跃。经治疗2天后，患者消化道出血得到控制，但出现幻觉、烦躁不安，下列处理措施中不正确的是
A. 急查血氨
B. 检测血电解质
C. 应用支链氨基酸
D. 注射地西泮10mg
E. 进行血气分析

正确答案：D。注射地西泮10mg